山茱萸不具有的作用是
A. 补肾益精
B. 收敛固涩
C. 温肾助阳
D. 固冲任
E. 收涩止泻

正确答案：E。收涩止泻

解析：本题考查山茱萸的功效。山茱萸具有补益肝肾，收敛固涩的作用，同时既能益精，亦可助阳，为平补阴阳要药；既能补肾益精，又能固精缩尿，为固精止遗之要药；能补肝肾、固冲任以止血，可用于崩漏，月经过多；能收敛止汗，固涩滑脱，为防止元气虚脱之要药（E错，为本题正确答案）。